蛋白质中对280nm紫外光吸收最强的氨基酸残基是
A. 谷氨酸
B. 赖氨酸
C. 丙氨酸
D. 组氨酸
E. 色氨酸

正确答案：E。色氨酸

解析：根据氨基酸的吸收光谱，含有共轭双键的色氨酸（E对）、酪氨酸的最大吸收峰在280nm波长附近。由于蛋白质分子中含有共轭双键的酪氨酸和色氨酸，因此在280nm波长处有特征性吸收峰。